酶化学修饰调节最多见的是
A. 别构调节
B. 磷酸化/去磷酸化
C. 酶原激活
D. 催化物调节
E. 温度调节

正确答案：B。磷酸化/去磷酸化

解析：酶的化学修饰调节主要有磷酸化与去磷酸化、乙酰化与去乙酰化、甲基化与去甲基化、腺苷化与去腺苷化及SH与—S—S—互变，其中磷酸化与去磷酸化最多见（B对）。别构调节（A错）是有别于化学修饰的另一种酶促反应的快速调节方式。酶原激活（C错）即无活性的酶原转变为有活性的酶的过程，是酶化学修饰调节的结果。催化物调节（D错）和温度调节（E错）只是影响酶促反应的速率，非化学修饰调节。